检查盐酸美他环素中的差向异构体、脱水美他环素及其他杂质，采用
A. 比色法
B. 比浊法
C. 在490mm处测定吸收度的方法
D. 高效液相色谱法
E. 薄层色谱法

正确答案：E。薄层色谱法